制备固体分散物的方法
A. 重结晶法
B. 熔融法
C. 注入法
D. 复凝聚法
E. 热分析法

正确答案：B。熔融法